氟化物毒作用的靶器官是
A. 脑
B. 肺
C. 骨骼
D. 肝
E. 肾

正确答案：C。骨骼